油脂经反复高温加热，可促使脂肪产生
A. 褐变
B. 二甲基亚硝胺
C. 胺类
D. 苯并（a）芘
E. AFB₁

正确答案：D。苯并（a）芘